男，30岁。上腹部持续饱胀不适感半年，餐后症状加重，但食欲及体重无明显变化。出现黑便3天，每日一次，大便成型有光泽。体检：上腹部轻压痛，肝脾肋下未触及，无明显贫血面容。最可能诊断为
A. 慢性胃窦炎
B. 慢性胃体炎
C. 十二指肠球部溃疡
D. 胃溃疡
E. 胃癌

正确答案：D。胃溃疡

解析：患者上腹部持续饱胀不适感半年，餐后症状加重，但食欲及体重无明显变化。出现黑便3天，每日一次，大便成型有光泽。体检：上腹部轻压痛，肝脾肋下未触及，无明显贫血面容。最可能诊断为胃溃疡（D对）。慢性胃窦炎（A错）、慢性胃体炎（B错）一般表现为上腹胀满不适、隐痛、嗳气、反酸、食欲不佳等消化不良症状，疼痛一般无明显规律性。十二指肠球部溃疡（C错）疼痛的节律性表现为两餐之间痛，进食后缓解。胃癌（E错）的特点为乏力、食欲不振、恶心、消瘦、贫血、水肿、发热、便秘等。